乙酰胆碱
A. M胆碱受体激动
B. N胆碱受体激动
C. 两者均激动
D. 两者均不能激动

正确答案：C。两者均激动